在巨幼细胞贫血的治疗中，为避免加重神经系统损害，应与叶酸联合应用的药
A. 维生素B₁
B. 维生素B₁₂
C. 维生素B
D. 维生素K₁
E. 维生素C

正确答案：B。维生素B₁₂

解析：本题考查药物的联合应用。在巨幼细胞贫血的治疗中，为避免加重神经系统损害，应与叶酸联合应用的药物是维生素B₁₂（B对）。维生素C（E错）可促进叶酸转化成具有生理活性的四氢叶酸，并提高四氢叶酸及其衍生物的稳定性，故叶酸治疗时可加用维生素C。